需要在特殊蓝色光源下，显示出黄色的菌斑显示剂为
A. 2%碱性品红
B. 2%-5%藻红片剂
C. 酒石黄
D. 1%--2.5%孔雀绿
E. 荧光素钠

正确答案：E。荧光素钠

解析：本题考查显示菌斑的方法。需要在特殊蓝色光源下，显示出黄色的菌斑显示剂为荧光素钠（E对）。常用的菌斑显示剂有赤藓红、碱性品红、荧光素钠等制成的溶液或片剂。荧光素纳在特殊的蓝色光源下，菌斑显出黄色，因此，荧光素钠制成的菌斑显示液需要在蓝相光固化灯下观察。